不含副交感神经纤维的脑神经是
A. 三叉神经
B. 动眼神经
C. 舌咽神经
D. 迷走神经
E. 无

正确答案：A。三叉神经

解析：不含副交感神经纤维的脑神经是三叉神经（A对），三叉神经只含一般躯体感觉纤维、特殊内脏运动纤维。动眼神经（B错）的副交感纤维支配瞳孔括约肌、睫状肌。舌咽神经（C错）的副交感纤维支配腮腺分泌。迷走神经（D错）的副交感纤维支配颈、胸、腹内脏平滑肌、心肌、腺体活动。